破伤风的常见致病菌是
A. 梭状芽孢杆菌
B. 金黄色葡萄球菌
C. 溶血性链球菌
D. 铜绿假单胞菌
E. 大肠埃希菌

正确答案：A。梭状芽孢杆菌